取主穴外，还应选用的穴位是
A. 膏肓
B. 膈俞
C. 志室
D. 腰阳关
E. 环跳

正确答案：B。膈俞

解析：本题考查常见的病症的辩证、处方。题中患者以腰部疼痛10余年为主症，故诊断为腰痛。有劳伤史，久坐加重，病处固定不移，故辨为瘀血腰痛。膏肓穴主治咳嗽、气喘、肺痨等肺之虚损证，肩胛痛，健忘、遗精、盗汗等虚劳诸疾（A错）。膈俞可治疗瘀血诸证，瘀血腰痛当加膈俞（B对）。志室为膀胱经腰痛的配穴（C错）。腰阳关为寒湿腰痛的配穴（D错）。环跳为坐骨神经痛的主穴（E错）。